吴茱萸粉末的显微特征有
A. 壁内腺
B. 腺毛头多细胞，内含棕色物质，柄为多细胞
C. 非腺毛多细胞，有明显壁疣
D. 草酸钙针晶成束
E. 石细胞胞腔大，壁孔明显

正确答案：B、C、E。腺毛头多细胞，内含棕色物质，柄为多细胞；非腺毛多细胞，有明显壁疣；石细胞胞腔大，壁孔明显